患者，男，24岁，诉右下后牙冷热刺激痛夜间痛3天。检查，右下第三磨牙近中低位阻生，右下78之间较多的食物嵌塞，右下8未探及龋坏，远中有盲袋略红肿，触疼痛。冷（-）。探及右下7远中颈部龋，探深，质软，冷刺激引发剧痛。主诉牙拟诊
A. 右下8冠周炎
B. 右下7急性根尖炎
C. 右下78牙周炎
D. 右下7急性牙髓炎
E. 右下8近中低位阻生

正确答案：D。右下7急性牙髓炎

解析：本题考查急性牙髓炎的临床表现。急性牙髓炎表现为冷热刺激痛、夜间痛、疼痛不能自行定位（D对）。智齿冠周炎无冷热刺激痛及夜间痛的表现，与主诉不符（A错）。急性根尖周炎，表现为自发性、剧烈持续的跳痛，有咬合痛及扣痛（B错）。牙周炎主要表现为牙龈炎症、附着丧失、牙槽骨吸收以及晚期牙松动等（C错）。近中低位阻生智齿，可造成智齿冠周炎，引起邻牙的龋损和牙髓炎（E错）。